属于大气中的二次污染物的是
A. SO₂
B. H₂S
C. CO₂
D. O₃
E. NO₂

正确答案：D。O₃

解析：本题考查二次污染物。二次污染物是指排入大气的污染物在物理、化学等因素的作用下发生变化，或与环境中的其他物质发生反应所形成的理化性质不同于一次污染物的新的污染物。常见的有O₃（D对ABCE错）。